某男，50岁。感冒数日，症见寒热往来、胸胖苦满、食欲不振、心烦喜呕、口苦咽干，中医诊断为外感病邪犯少阳证。治当解表散热，疏肝和胃。处以小柴胡汤，其药物组成为柴胡、黄芩、党参、大枣、生姜、姜半夏、甘草。处方中，属于辛凉解表药，具有清肺解热作用的中药是
A. 党参
B. 柴胡
C. 黄芩
D. 生姜
E. 甘草

正确答案：B。柴胡

解析：本题考查的是柴胡的功效。处以小柴胡汤，其药物组成为柴胡、黄芩、党参、大枣、生姜、姜半夏、甘草。处方中，属于辛凉解表药，具有清肺解热作用的中药是柴胡（B对）。柴胡：【功效】解表退热，疏肝解郁，升举阳气。党参（A错）：【功效】补中益气，生津养血。黄芩（C错）：【功效】清热燥湿，泻火解毒，止血，安胎。生姜（D错）：【功效】发汗解表，温中止呕，温肺止咳。甘草（E错）：【功效】益气补中，祛痰止咳，解毒，缓急止痛，缓和药性。